引起药物副作用的原因是
A. 药物的毒性反应大
B. 机体对药物过于敏感
C. 药物对机体的选择性高
D. 药物对机体的作用过强
E. 药物的作用广泛

正确答案：E。药物的作用广泛